属α₁受体拮抗剂的药物是
B. 盐酸哌唑嗪
C. 氯沙坦
D. 盐酸地尔硫䓬
E. 利血平

正确答案：B。盐酸哌唑嗪

解析：本题考查药物的分类。属α₁受体拮抗剂的药物是盐酸哌唑嗪（B对）。盐酸哌唑嗪是α₁受体拮抗剂，通过扩张血管使血压降低，主要用于治疗轻、中度高血压。马来酸依那普利（A错）是血管紧张素转化酶抑制剂，主要用于治疗高血压及心力衰竭。氯沙坦（C错）是血管紧张素Ⅱ受体拮抗剂，主要用于治疗原发性高血压。盐酸地尔硫䓬（D错）是钙离子通道阻滞剂，主要用于治疗高血压、心绞痛、心律失常。利血平（E错）是吲哚类生物碱，是一种中枢类的降压药，抑制中枢交感神经的调节，主要用于治疗高血压。